甘遂的用法用量正确的是
A. 甘遂入丸散;0.1~0.3g
B. 甘遂入丸散;0.5~1g
C. 甘遂入丸散;2~2.5g
D. 甘遂入汤散;3~10g
E. 甘遂入汤散;10~15g

正确答案：B。甘遂入丸散;0.5~1g

解析：甘遂的用法用量是入丸、散服，每次0.5-1g。外用适量，生用。内服醋制用，以减低毒性（B对）。生甘遂作用较强，毒性亦较大，醋之后其泻下作用和毒性均有减低的药理作用。